女，35岁，肺结核患者，肺内有空洞性病变。最符合的X线表现是
A. 上叶尖后段空洞，壁光整，周围有卫星灶
B. 下叶空洞周围大片炎性浸润
C. 空洞内壁不规则，凹凸不平
D. 厚壁空洞偏心
E. 厚壁空洞伴有液平面

正确答案：A。上叶尖后段空洞，壁光整，周围有卫星灶

解析：肺结核的X线胸片主要表现为上叶尖后段、下叶的背段和后基底段，呈多态性，即浸润、增殖、干酪、纤维钙化病变可同时存在，密度不均匀、边缘较清楚和病变变化较慢，易形成空洞和播散病灶，如果结核纤维空洞继发感染，X线可显示空洞壁较厚，一般无气液平面，空洞周围炎性病变较少，常伴有条索、斑点及结节状病灶，或肺内其他部位的播散灶（A对）。下叶空洞周围大片炎性浸润（B错）和厚壁空洞伴有液平面（E错）为肺脓肿的典型表现，而非肺结核的典型X线表现。空洞内壁不规则，凹凸不平（C错）和厚壁空洞偏心（D错）为支气管肺癌的典型表现，而非肺结核的典型X线表现。